女，62岁。既往体健，绝经10年。因阴道不规则流血、流液3个月入院。查体：宫颈肥大，后唇见一菜花状肿物，累及后穹窿部，质脆，触之易出血，直径约3cm，三合诊示子宫稍大，双侧附件未触及明显异常。宫颈活检示鳞状细胞癌。患者的临床分期应为
A. ⅠB1
B. ⅠB2
C. ⅡA
D. ⅡB
E. ⅢA

正确答案：C。ⅡA